坐骨棘存在于
A. 股骨大、小转子之间
B. 股骨内、外侧髁之间
C. 左、右侧耻骨结节之间
D. 坐骨大、小切迹之间
E. 髂前上棘与髂结节之间

正确答案：D。坐骨大、小切迹之间

解析：坐骨棘存在于坐骨大、小切迹之间（D对）。股骨大、小转子之间前面有转子间线，后面有转子间嵴 （A错）。股骨内、外侧髁之间深窝称髁间窝（B错）。